患者，女，67岁，高血压、2型糖尿病、冠心病病史13年，既往血压最高达到180/115mmHg。规律服用氨氯地平、比索洛尔、西格列汀、二甲双胍，3年前发生缺血性脑卒中。近期记忆力下降明显，伴认知功能障碍加重入院。查体：血压155/95mmHg，心率92次/分，呼吸14次/分，体温36.5℃。意识清，少语，动作迟缓，空间感、时间感、计算力、近记忆力、定向力下降，共济运动检查欠合作；影像提示：脑内多发陈旧性缺血梗死灶、脑室扩大、脑萎缩、左侧大脑中动脉纤细合并局限性狭窄。诊断为血管性痴呆、高血压3级（很高危）、2型糖尿病、冠心病。该患者出院后，常出现体位性眩晕、耳鸣，可选用的药物是
A. 倍他司汀
B. 艾地苯醌
C. 奥拉西坦
D. 胞磷胆碱钠
E. 恩他卡朋

正确答案：A。倍他司汀

解析：本题考查倍他司汀的药理作用。倍他司汀（A对）在临床主要用于内耳眩晕症，亦可用于脑动脉硬化、缺血性脑血管疾病及高血压所致体位性眩晕、耳鸣。